智慧敏捷，缺乏准确性；热情但急躁、易冲动是哪种人的气质特征
A. 胆汁质
B. 多血质
C. 黏液质
D. 抑郁质
E. 其他

正确答案：A。胆汁质